屈肌反射是
A. 翻正反射
B. 防御反射
C. 牵张反射
D. 状态反射
E. 对侧伸肌反射

正确答案：B。防御反射